黄芪的主治病证不包括
A. 血痹肢麻
B. 气虚水肿
C. 自汗盗汗
D. 胎动不安
E. 中气下陷

正确答案：D。胎动不安

解析：本题考查黄芪的主治病证。黄芪的主治病证不包括胎动不安（D错，为本题正确答案）。黄芪【主治病证】（1）脾胃气虚，脾肺气虚，中气下陷（E对），气不摄血，气虚发热。（2）自汗，盗汗（C对）。（3）气血不足所致的疮痈不溃或溃久不敛。（4）气虚水肿（B对）、小便不利。（5）气血双亏，血虚萎黄，血痹肢麻（A对），半身不遂，消渴。白术【主治病证】（1）脾胃气虚之食少便溏、倦怠乏力。（2）脾虚水肿，痰饮。（3）表虚自汗。（4）脾虚气弱之胎动不安。